男性，42岁，5年前体检发现HBsAg（+），但肝功能正常，未予理会。近2个月来感到体力和食欲均减退，查ALT240IU/L，TBil为40mol/L，HBsAg（+）。最有可能的诊断是
A. 急性黄疸型肝炎
B. 急性重型肝炎
C. 亚急性重型肝炎
D. 慢性乙型肝炎
E. 慢性重型肝炎

正确答案：D。慢性乙型肝炎